颌面部疖痈最常见的致病菌是
A. 白色念珠菌
B. 溶血性链球菌
C. 厌氧性链球菌
D. 铜绿假单胞菌
E. 金黄色葡萄球菌

正确答案：E。金黄色葡萄球菌

解析：面部疖痈是一种急性化脓性炎症，最常见的致病菌是金黄色葡萄球菌。掌握“面部疖痈”知识点。